脑压过高，为预防脑痛最好选用
A. 呋塞米
B. 阿米洛利
C. 螺内酯
D. 乙酰唑胺
E. 甘露醇

正确答案：E。甘露醇